FC活髓切断术时FC小棉球应放置的时间一般为
A. 1分钟
B. 2分钟
C. 3分钟
D. 5分钟
E. 10分钟

正确答案：A。1分钟

解析：本题考查乳牙牙髓切断术。活髓切断术是在局麻下去除冠方的牙髓组织，用药物处理牙髓创面以保存根部健康牙髓，恒牙常用氢氧化钙，乳牙常用甲醛甲酚FC，达到固定牙髓断面的表面组织和杀灭表面微生物的作用。FC的用法是去除冠髓后用FC小棉球放置在牙髓断面上1分钟（A对），以固定表面组织，产生封闭作用，然后将调制好的氧化锌丁香油水门汀盖于牙髓断面，用湿棉球轻压使其与根髓密切贴合。时间过短难以发挥作用，时间过长（BCDE错）又会损伤根尖组织。